男性，40岁，有明显黄疸，皮肤瘙痒1个月，粪便颜色变浅，伴轻度乏力，腹胀，肝肋下触及2cm，脾侧卧未及，ALT120U/L，胆红素定量230umol/L，碱性磷酸酶、γ-GT、胆固醇增高。此患者主要需和哪种疾病鉴别
A. 急性黄疸型肝炎
B. 胆囊炎
C. 胆汁性肝硬化
D. 肝吸虫病
E. 肝外梗阻性黄疸

正确答案：E。肝外梗阻性黄疸

解析：中年男性，黄疸，皮肤瘙痒一个月，粪便颜色变浅（符合胆汁淤积性黄疸的临床表现），伴轻度乏力，腹胀，肝肋下触及2cm（提示肝脏增大），脾侧卧未及，ALT120U/L（正常值＜40U/L，提示存在肝功能损伤），胆红素定量230umol/L（正常值为3.4～14.1umol/L），碱性磷酸酶、γ-GT、胆固醇增高（实验室检查符合胆汁淤积性黄疸）。综合该患者的临床表现、症状和实验室检查，考虑为胆汁淤积型肝炎。胆汁淤积性黄疸又分为肝内性和肝外性，这两者在临床表现上比较相似，所以因进一步鉴别（E对）